妊娠期龈炎的可疑致病菌是
A. 黏性放线菌
B. 中间普氏菌
C. 内氏放线菌
D. 微小消化链球菌
E. 牙龈二氧化碳噬纤维菌

正确答案：B。中间普氏菌

解析：本题考查妊娠期龈炎的病因。妊娠期龈炎指妇女在妊娠期间，由于女性的激素水平升高，原有的牙龈慢性炎症加重，使牙龈肿胀或形成龈瘤样的改变分娩后病情可自行减轻或消退。中间普氏菌（B对）是妊娠期龈炎的可疑致病菌。黏性放线菌（A错）、内氏放线菌（C错）、牙龈二氧化碳噬纤维菌（D错）均是牙龈炎的可疑致病菌。微小消化链球菌（E错）寄生于口腔牙缝，常因为拔牙进入血液引起亚急性细菌性心内膜炎，也常在头颈部、口咽、上呼吸道感染中呈现。与龋源性牙髓炎所致牙髓组织炎症和坏死有重要关系。